干眼病
A. 维生素B₁缺乏
B. 维生素B₂缺乏
C. 维生素A缺乏
D. 维生素C缺乏
E. 烟酸缺乏

正确答案：C。维生素A缺乏